有关多形渗出性红斑下列哪项描述是错误的
A. 是一种变态反应性疾病
B. 口腔黏膜表现为大面积糜烂
C. 皮肤损害为红斑、水疱，亦可见丘疹
D. 眼部病损为虹膜睫状体炎及前房积脓
E. 可伴有明显的全身反应，如高热、头痛等

正确答案：D。眼部病损为虹膜睫状体炎及前房积脓

解析：本题考查多形红斑。有关多形渗出性红斑错误的是眼部病损为虹膜睫状体炎及前房积脓（D错，为本题的正确答案）。多形性红斑又称多形渗出性红斑，是黏膜皮肤的一种急性渗出性炎症性疾病，Ⅲ型超敏反应，即变态反应（A对）发病急，具有自限性和复发性。黏膜和皮肤可同时发病，口腔黏膜可见水疱，疱破溃后形成糜烂面（B对），皮肤水疱、丘疹、红斑（C对），严重可有全身症状（E对），眼结膜毛细血管广泛充血发红有炎症，亦可出现丘疹或疱疹，严重时可出现角膜溃疡、脉络膜炎，即斯-约综合症，并非虹膜睫状体炎。